流行性出血热的基本病理变化是
A. 急性肾功能衰竭
B. 弥散性血管内凝血
C. 全身广泛性小血管损害
D. 低血容量休克
E. 微循环障碍

正确答案：C。全身广泛性小血管损害